长期大量使用糖皮质激素时会出现
A. 血中ACTH含量升高
B. 血中ACTH含量降低
C. 血中ACTH含量不变
D. 血中ACTH含量先降低后升高
E. 血中ACTH含量时高时低

正确答案：B。血中ACTH含量降低